大脑大静脉收集大脑深部的静脉血后直接最后注
A. 上矢状窦
B. 第四脑室脉络丛
C. 第三脑室脉络丛
D. 直窦
E. 无

正确答案：D。直窦

解析：大脑上静脉收集大脑深部的静脉血最后注入上矢状窦（A错）。第四脑室脉络丛（B错）和第三脑室脉络丛（C错）主要参与脑脊液循环。大脑大静脉收集大脑深部的静脉血后直接最后注直窦（D对）。